去除中药提取物中鞣质的方法有
A. 石灰法
B. 水蒸气蒸馏法
C. 聚酰胺吸附法
D. 铅盐法
E. 升华法

正确答案：A、C、D。石灰法；聚酰胺吸附法；铅盐法

解析：本题考查除去鞣质的方法。去除中药提取物中鞣质的方法有石灰法（A对）、聚酰胺吸附法（C对）、铅盐法（D对）。石灰法：利用鞣质与钙离子结合生成水不溶性沉淀，故可在中药的水提液中加入氢氧化钙，使鞣质沉淀析出；或在中药原料中拌入石灰乳，使鞣质与钙离子结合生成水不溶物，使之与其他成分分离。聚酰胺吸附法：将中药的水提液通过聚酰胺柱，鞣质与聚酰胺以氢键结合而牢牢吸附在聚酰胺柱上，80%乙醇亦难以洗脱，而中药中其他成分大部分可被80%乙醇洗脱下来，从而达到除去鞣质的目的。铅盐法：在中药的水提取液中加入饱和的乙酸铅或碱式乙酸铅溶液，可使鞣质沉淀而被除去，然后按常规方法除去滤液中过剩的铅盐。除去鞣质的方法：冷热处理法、石灰法、铅盐法、明胶法、聚酰胺吸附法、溶剂法。水蒸气蒸馏法（B错）：用于提取能随水蒸气蒸馏而不被破坏的难溶于水的成分。升华法（E错）：有些固体物质受热后会直接汽化，遇冷后又凝固为原来的固体化合物，此现象被称为升华。